细胞外液中的葡萄糖进入一般细胞的过程属于
A. 单纯扩散
B. 易化扩散
C. 主动转运
D. 入胞式物质转运
E. 受体介导式入胞

正确答案：B。易化扩散